女，45岁，两年来下前牙牙龈肿胀，时有脓血溢出，自觉牙齿活动。检查见牙龈红肿，下中切牙及侧切牙II度松动，根面有较多牙石，探诊牙周袋深度为5mm，袋内有少量脓液，应首先考虑
A. 慢性牙龈炎
B. 牙周炎
C. 牙龈增生
D. 牙周萎缩
E. 牙周创伤

正确答案：B。牙周炎

解析：本题考查牙周炎。患者两年来下前牙牙龈肿胀，时有脓血溢出，自觉牙齿活动。检查见牙龈红肿（牙龈红肿）（D错），下中切牙及侧切牙II度松动（牙齿松动），根面有较多牙石（口腔卫生不佳），探诊牙周袋深度为5mm（有附着丧失）（AC错），袋内有少量脓液，应首先考虑牙周炎（B对）。牙周创伤（E错）通常以牙痛、长期咬合不适和叩诊时不同程度的疼痛为特征，X线片主要表现为牙周膜增宽。